患者，男，59岁，诊断为急性心绞痛，医生处方硝酸甘油片，舌下含服，要适应交代的注意事项包括
A. 服药时尽量应采取坐、卧位
B. 口腔黏膜干燥者先用水润湿口腔后再含服
C. 服药后可能出现头痛、面部潮红
D. 咳嗽是典型的不良反应
E. 15分钟内重复给药3次，症状仍不能缓解，应及时就医

正确答案：A、B、C、E。服药时尽量应采取坐、卧位；口腔黏膜干燥者先用水润湿口腔后再含服；服药后可能出现头痛、面部潮红；15分钟内重复给药3次，症状仍不能缓解，应及时就医

解析：本题考查硝酸甘油的使用。患者服用硝酸甘油片时应采取坐位、卧位（A对），因为硝酸甘油会引起体位性低血压，突然站立后会导致头晕等症状。口腔黏膜干燥会造成药物失效，故口腔干燥者服用前先用水润湿口腔（B对）。硝酸甘油不良反应有头痛、面部潮红、心跳加快等，但不会引起咳嗽（C对D错）。硝酸甘油起效快，如15分钟内重复给药3次（E对），症状仍不能缓解，说明症状严重或是其它心血管疾病，应及时就医。